患者素有足癣史，1周前左第1、2趾缝间作痒，糜烂流脓加重，2天前左大趾至小腿内侧出现红丝1条，宽约3mm，色红灼热，边界清楚，压痛明显，并伴有左腹股沟结块疼痛。诊断是
A. 丹毒
B. 烂疔
C. 类丹毒
D. 红丝疔
E. 附骨疽

正确答案：D。红丝疔

解析：丹毒是患部皮肤突然发红成片、色如涂丹的急性感染性疾病，本病患者出现红丝，发红未成片（A错）。烂疔是发生于皮肉之间、腐烂甚剧、病势暴急的急性化脓性疾病（B错）。类丹毒多发于手部，有猪骨或鱼虾之刺划破皮肤史，红斑范围小，症状轻，无明显全身症状（C错）。红丝疔是发于四肢，皮肤呈红丝显露，迅速向上走窜的急性感染性疾病，符合患者表现（D对）。附骨疽儿童常见，多发于四肢长骨，局部胖肿，附筋着骨，推之不移，疼痛彻骨（E错）。